患者，女，56岁。咳喘10年，伴见胸闷心悸，咳痰清稀，声低乏力，面白神疲，舌质淡白，脉弱，其证候是
A. 心肺气虚
B. 肺气虚
C. 寒邪客肺
D. 脾肺气虚
E. 肾不纳气

正确答案：A。心肺气虚

解析：患者肺气亏虚，肃降无权，肺气上逆，故咳嗽，气喘；心气亏虚，鼓动无力，气机不畅，故心悸胸闷；肺气虚，宗气不足，则气短，声低乏力，面白神疲；肺气虚，津液输布无力，水液停聚为痰，故咳痰清稀；面色淡白，舌淡苔白，脉弱等，均为气虚常见之征；故辨证为心肺气虚证（A对）。肺气虚证是以咳嗽、气喘，自汗、易于感冒及气虚症状为主要表现的证（B错）。寒邪客肺是以咳嗽及风寒表证症状为主要表现的证（C错）。脾肺气虚是以咳嗽、气喘、食少、腹胀、便溏及气虚症状为主要表现的证（D错）。肾不纳气证是以久病咳喘、呼多吸少、动则尤甚及肾虚症状为主要表现的证（E错）。